某女，45岁，因思虑伤脾导致胸闷、脘腹胀痛、不思饮食，治当行气止痛、开郁醒脾，宜选用的药是
A. 梅花
B. 甘松
C. 玫瑰花
D. 木香
E. 化橘红

正确答案：B。甘松

解析：本题考查的是甘松的功效。因思虑伤脾导致胸闷、脘腹胀痛、不思饮食，治当行气止痛、开郁醒脾，宜选用的药是甘松（B对）。甘松：【功效】行气止痛，开郁醒脾。梅花（A错）：【功效】疏肝解郁，和中，化痰。玫瑰花（C错）：【功效】行气解郁，活血止痛。木香（D错）：【功效】行气止痛，健脾消食。化橘红（E错）：【功效】理气宽中，燥湿化痰，消食。